蠕变值高的银汞合金
A. 在遇到温度变化时易于膨胀
B. 在遇到温度变化时易于收缩
C. 易于产生充填物边缘缺陷
D. 有较高的抗压强度

正确答案：C。易于产生充填物边缘缺陷

解析：本题考查银汞合金的性能-蠕变。蠕变值高的银汞合金，易于产生充填物边缘缺陷（C对），充填修复体边缘长期受压后容易翘起，失去釉质支持，容易断裂抗压强度较小（D错）。温度升高，银汞合金的蠕变值增大易于收缩，温度降低，银汞合金的蠕变值减小易于膨胀，所以在遇到温度变化时易于膨胀（A错）、在遇到温度变化时易于收缩（B错）的说法不具体。